大面积烧伤48h内最主要的全身改变指
A. 创伤性休克
B. 低血容量休克
C. 毒血症
D. 创面脓毒症
E. 急性肾功能衰竭

正确答案：B。低血容量休克

解析：烧伤面积较大，尤其是抢救不及时或不当，会造成人体不足以代偿迅速发生的体液丧失，循环血量下降，导致低血容量性休克的发生。掌握“火器伤、热烧伤”知识点。